发生职业疾患所应具备作用条件的接触机会
A. 生产工艺过程中使用某种毒物
B. 苯经皮肤进入人体
C. 噪声环境中每天工作4小时
D. 工作场所射频辐射6V/m
E. 作业地点局部通风

正确答案：A。生产工艺过程中使用某种毒物